药物与血浆蛋白结合后，药物
A. 作用增强
B. 代谢加快
C. 转运加快
D. 排泄加快
E. 暂时失去药理活性

正确答案：E。暂时失去药理活性

解析：本题考查影响药物分布的因素。药物与血浆蛋白的结合是可逆过程，结合型药物暂时失去药理活性（E对）；药物与蛋白质结合后，作用减弱（A错），不能进行转运（C错），不能由肾小球滤过（D错），不能经肝脏代谢（B错）。